胆固醇在体内代谢主要去路是
A. 氧化分解为CO₂和H₂O
B. 在肝脏转化为胆汁酸
C. 转变为维生素D₃
D. 生成类固醇化合物
E. 还原成类固醇

正确答案：B。在肝脏转化为胆汁酸

解析：胆固醇在体内不能被彻底氧化分解为CO₂和H₂O，而是经氧化、还原生成其他多种重要的类固醇化合物。其在肝脏可转化为胆汁酸，这是胆固醇在体内代谢的主要去路。掌握“甘油磷脂、胆固醇和血脂蛋白代谢”知识点。